可与吸入性糖皮质激素合用的长效M胆碱受体阻断剂是
A. 多索茶碱
B. 孟鲁司特
C. 沙美特罗
D. 噻托溴铵
E. 沙丁胺醇

正确答案：D。噻托溴铵

解析：本题考查噻托溴铵。可与吸入性糖皮质激素合用的长效M胆碱受体阻断剂是噻托溴铵（D对）。噻托溴铵干粉吸入剂为长效胆碱受体阻断剂，与β₂受体激动剂、磷酸二脂酶抑制剂、吸入性糖皮质激素联合应用可增强本品对支气管的扩张作用，使支气管舒张作用增强并持久。多索茶碱（A错）为黄嘌呤类平喘药。孟鲁司特（B错）为白三烯受体阻断剂。沙美特罗（C错）为长效β₂受体激动剂。沙丁胺醇（E错）为短效β₂受体激动剂。